下述制剂不得添加抑菌剂的是
A. 用于全身治疗的栓剂
B. 用于局部治疗的软膏剂
C. 用于创伤的眼膏剂
D. 用于全身治疗的软膏剂
E. 用于局部治疗的凝胶剂

正确答案：C。用于创伤的眼膏剂

解析：本题考查抑菌剂。眼部容易受到抑菌剂的损害，用于创伤的眼膏剂（C错，为本题正确答案）不能添加抑菌剂；用于全身治疗的栓剂（A对）、用于局部治疗的软膏剂（B对）、用于全身治疗的软膏剂（D对）、用于局部治疗的凝胶剂（E对）可以添加抑菌剂。